下列不属于山莨菪碱的是
A. 用于感染性休克
B. 合成扩瞳药
C. 人工合成品654-2
D. 用于血管神经性头痛
E. 用于内脏平滑肌绞痛

正确答案：B。合成扩瞳药

解析：山莨菪碱应用于感染中毒休克（A对）、内脏平滑肌绞痛（E对）、血管神经性头痛（D对）、眩晕症。山莨菪碱（anisodamine，654-2）是我国学者从茄科植物山莨菪（唐古特莨菪）中分离出的一种生物碱，现已可人工合成（C对）。阿托品合成了许多选择性较高的代用品，其中包括扩瞳药、解痉药、选择性M受体阻断药（B错，为本题正确答案）。